属于第三级预防措施的是
A. 心理康复
B. 戒烟限酒
C. 遗传咨询
D. 早期诊断
E. 体育锻炼

正确答案：A。心理康复